可预防哮喘发作，对正在发作无效的是
A. 氨茶碱
B. 沙丁胺醇
C. 倍氯米松
D. 异丙肾上腺素
E. 色甘酸钠

正确答案：E。色甘酸钠

解析：本题考查哮喘治疗药物的特点。临床上用于预防支气管哮喘，对正在发作的哮喘无效的药物是色甘酸钠（E对）。色甘酸钠只能作为预防性用药，而对于治疗支气管哮喘没有作用。